女性，65岁。近一年来大便次数增多、伴腹泻，腹泻便秘交替出现，偶有血便，一天前突发上腹部疼痛，呈阵发性加重，伴恶心、无呕吐，查体：体温37.5℃，血压100/70mmHg，上腹正中可触及一大小约5cm包块，全腹轻压痛，无反跳痛、无肌紧张。对明确诊断有意义的检查是
A. 腹部B超
B. 腹部MRI
C. 结肠镜
D. 腹部CT
E. 下消化道造影

正确答案：C。结肠镜

解析：老年女性患者，排便次数增多、腹泻、便秘、便中带血（结直肠癌常见症状），上腹部疼痛，呈阵发性加重，上腹正中可触及一大小约5cm包块，最可能的诊断为横结肠癌。对明确诊断有意义的检查是结肠镜（C对）。